《“健康中国2030”规划纲要》确定的健康中国战略目标，到2030年需要实现的目标包括
A. 基本实现健康公平
B. 主要健康指标进入高收入国家行列
C. 建成基本医疗保障全覆盖的健康国家
D. 促进全民健康的制度体系更加完善

正确答案：A、B、D。基本实现健康公平；主要健康指标进入高收入国家行列；促进全民健康的制度体系更加完善

解析：本题考查《“健康中国2030”规划纲要》的主要战略目标。说法正确的是基本实现健康公平（A对）；主要健康指标进入高收入国家行列（B对）；建成基本医疗保障全覆盖的健康国家（C对）；促进全民健康的制度体系更加完善（D对）。到2030年，促进全民健康的制度体系更加完善，健康领域发展更加协调，健康生活方式得到普及，健康服务质量和健康保障水平不断提高，健康产业繁荣发展，基本实现健康公平，主要健康指标进入高收入国家行列。到2050年，建成与社会主义现代化国家相适应的健康国家。健全全民医保制度（C错）：健全基本医疗保险稳定可持续筹资和待遇调整机制，完善医保缴费参保政策，实行医疗保障待遇清单制度。